治疗下肢丹毒宜选用中成药是
A. 天麻片
B. 跌打丸
C. 二妙丸
D. 追风透骨膏
E. 红药气雾剂

正确答案：C。二妙丸

解析：本题考查的是二妙丸的主治。治疗下肢丹毒宜选用中成药是二妙丸（C对）。二妙丸【主治】湿热下注，足膝红肿热痛，下肢丹毒，白带，阴囊湿痒。天麻片（A错）【主治】肢体拘挛，手足麻木，腰腿酸痛。跌打丸（B错）【主治】跌打损伤，筋断骨折，瘀血肿痛，闪腰岔气。追风透骨膏（D错）【主治】风湿类风湿关节炎、肩周炎。红药气雾剂（E错）【主治】跌打损伤，局部瘀血肿胀，筋骨疼痛。